回力卡环
A. 卡臂尖位于基牙唇颊面倒凹区，绕过基牙近中面与支托相连，在近中舌侧与连接体相连
B. 卡臂尖位于基牙唇颊面倒凹区，绕过基牙近中面与支托相连，在远中舌侧与连接体相连
C. 卡臂尖位于基牙唇颊面倒凹区，绕过基牙远中面与支托相连，在近中舌侧与连接体相连
D. 卡臂尖位于基牙唇颊面倒凹区，绕过基牙远中面与支托相连，在远中舌侧与连接体相连
E. 卡臂尖位于基牙唇颊面倒凹区，绕过基牙近中面与支托相连，在近中颊侧与连接体相连

正确答案：C。卡臂尖位于基牙唇颊面倒凹区，绕过基牙远中面与支托相连，在近中舌侧与连接体相连

解析：本题考查回力卡环。回力卡环卡臂尖位于基牙唇颊面倒凹区，绕过基牙远中面与支托相连，在近中舌侧与连接体相连（C对）。这样设计是由于远中支托不与基托或连接杆相连，力通过人工牙和基托首先传导到基托下黏膜和骨组织，可减轻基牙受力，起到应力中断的作用。